复方短效口服避孕药的副反应，正确的是
A. 能引起经血量增多，不适用于经量偏多的妇女
B. 孕激素引起宫颈粘液量增多致白带增多
C. 体重减轻系因食欲不佳进食少
D. 孕激素刺激胃粘膜致类早孕反应
E. 能使水钠潴留

正确答案：E。能使水钠潴留

解析：复方短效避孕药使经量减少（A错）。复方短效口服避孕药含有孕激素，其作用机制是增加宫颈液的粘稠度来阻止精子穿越宫颈到达子宫和输卵管而不是增加宫颈粘液量（B错）；雌激素可引起宫颈粘液量增多致白带增多（B错）。复方短效口服避孕药对体重的影响，由于避孕药中的孕激素对雄激素受体没有亲和力，不会引起体重减轻；但是雌激素可以使体内水钠潴留，增加体重（C错）。 复方短效口服避孕药可引起类早孕反应，是雌激素的作用所致而不是孕激素的作用所致（D错），可出现头晕、恶心、择食、乳房胀痛等类早孕症状。雌激素有部分醛固酮（保钠保水），有一定的水钠潴留作用（E对），本题不严谨。